我国结核病分类不包括
A. 菌阴肺结核
B. 原发型肺结核
C. 血行播散型肺结核
D. 肺结核疑似病例
E. 继发型肺结核

正确答案：D。肺结核疑似病例

解析：1999年我国制定了结核病分类标准：原发型肺结核、血行播散型肺结核、继发型肺结核（按临床特点可分为：浸润性肺结核、空洞性肺结核、结核球、干酪性肺炎、纤维空洞性肺结核、结核性胸膜炎、其他肺外结核、菌阴肺结核）。掌握“肺结核”知识点。